关于线性药动学的说法，错误的是
A. 单室模型静脉注射给药，lgC对t作图，得到直线的斜率为负值
B. 单室模型静脉注射给药，在滴注开始时可以静注一个负荷剂量，使血药浓度迅速达到或接近稳态浓度
C. 单室模型口服给药，在血药浓度达峰瞬间，吸收速度等于消除速度
D. 多剂量给药，血药浓度波动与药物半衰期、给药间隔时间有关
E. 多剂量给药，相同给药间隔下，半衰期短的药物容易蓄积

正确答案：E。多剂量给药，相同给药间隔下，半衰期短的药物容易蓄积

解析：本题考查线性药动学。多剂量给药，相同给药间隔下，半衰期较大的药物容易蓄积（E错，为本题正确答案）；单室模型静脉注射给药lgC对t作图得到的是血药浓度与时间的关系，直线斜率为负值（A对）；在静脉滴注开始时静注一个负荷剂量，可以使血药浓度迅速达到或接近Css（B对）；单室模型口服给药，在达峰瞬间，吸收速度等于消除速度（C对）；多剂量给药，血药浓度波动与药物半衰期、给药间隔时间有关（D对）。